预后最差的肝性脑病患者是
A. 肝硬化伴腹腔积液者
B. 暴发性肝衰竭所致者
C. 诱因明确，且易消除者
D. 肝硬化伴黄疸者
E. 肝硬化伴自发性腹膜炎者

正确答案：B。暴发性肝衰竭所致者

解析：急性肝衰竭所致的肝性脑病预后最差（B对），诱因明确，且易消除者预后较好（C错），肝硬化伴腹腔积液者（A错）、肝硬化伴黄疸者（D错）、肝硬化伴自发性腹膜炎者（E错）其预后也差，但没有肝衰竭所致者严重。